有关公共卫生伦理学哪项理解不正确
A. 强调资源分配的公平
B. 研究对象是社会公众、健康人
C. 关注问题有预防、防止伤害发生、传染病流行
D. 研究侧重在影响健康的行为、生活方式等社会因素，落足于政策制定
E. 涉及单一的医患关系

正确答案：E。涉及单一的医患关系

解析：社群主义：评估公共政策好坏的关键就是是否有助于创造适合于个人生活于其中的社会形式。这种观点被称之为社群主义或“共同体主义”，它既不以权力也不依靠结果或健康福利为基础，而是侧重于灌输美德和以培育良好社区为宗旨。此为公共卫生伦理的理论基础。公共卫生伦理涉及到社会群体性的关系，不仅仅是单一的医患关系。掌握“公共卫生伦理含义、理论基础与原则”知识点。